关于口腔黏膜，以下哪项是错误的
A. 咀嚼黏膜的上皮较厚，可角化
B. 唇红部上皮有角化
C. 颊黏膜可发生异位增生的皮脂腺
D. 舌腹黏膜属于特殊黏膜
E. 唇的黏膜下层较厚，内含混合性腺体

正确答案：D。舌腹黏膜属于特殊黏膜

解析：本题考查口腔黏膜。舌腹黏膜属于被覆黏膜，舌背黏膜属于特殊黏膜（D错，为本题的正确答案）。咀嚼黏膜上皮较厚，可正角化或不全角化（A对）。唇红部上皮薄，有角化（B对）。颊黏膜可发生异位增生的皮脂腺（C对），呈成簇的粟粒状淡黄色小颗粒。唇的黏膜下层较厚，内含小唾液腺的混合性腺体（E对）。